具有调血脂、抗血栓形成、保护血管内皮、抗动脉粥样硬化作用的药物是
A. 洛伐他汀
B. 考来烯胺
C. 非诺贝特
D. 维生素E
E. 藻酸双酯钠

正确答案：A。洛伐他汀

解析：本题考查洛伐他汀。具有调血脂、抗血栓形成、保护血管内皮、抗动脉粥样硬化作用的药物是洛伐他汀（A对）。洛伐他汀为他汀类调血脂药，他汀类药物除了调血脂作用外，还有调节内皮功能、抗血小板黏附聚集、抗血栓形成、稳定粥样硬化斑块、抗氧化、抗炎、抑制心肌肥厚、促进骨形成和（或）抑制骨吸收等多方面作用。考来烯胺（B错）为胆汁酸结合树脂，主要用于治疗以TC和LDL-C升高为主，而且适用于TG水平正常不能使用他汀类的高胆固醇血症患者，如杂合子家族性Ⅱa型高脂血症。。非诺贝特（C错）为贝丁酸类调血脂药，贝特类药物除了具有调脂作用外，还具有抗炎、降低纤维蛋白原及部分凝血因子水平、改善胰岛素敏感性、改善内皮细胞功能等作用，有益于动脉粥样硬化的防治。维生素E（D错）用于进行性肌营养不良，以及心、脑血管疾病，习惯性流产及不孕症的辅助治疗。藻酸双酯钠（E错）用于缺血性心、脑血管病和高脂血症的防治。